甲状舌管囊肿的发生常见于
A. 舌骨体上下
B. 舌骨大角
C. 舌骨小角
D. 舌肌
E. 舌外肌

正确答案：A。舌骨体上下

解析：舌骨体为舌骨中部近似椭圆形的扁骨板，与下颌角处于同一水平。舌骨体上部有颏舌骨肌附着，下部则有下颌舌骨肌、胸骨舌骨肌和肩胛舌骨肌附着。甲状舌管囊肿的发生常见于舌骨体上下。掌握“蝶骨、颞骨及舌骨的解剖特点”知识点。